下列关于颈动脉窦和颈动脉小球的说法中，不正确的是
A. 颈动脉小球是化学感受器
B. 颈动脉窦是压力感受器
C. 颈动脉小球位于颈外动脉的后壁处
D. 颈动脉窦是颈内动脉起始部的膨大处
E. 颈动脉小球约为米粒大小

正确答案：C。颈动脉小球位于颈外动脉的后壁处

解析：颈动脉小球是化学感受器（A对）。颈动脉窦是压力感受器（B对）。颈动脉小球借结缔组织连于颈总动脉（C错，为本题正确答案）分杈处的后方。颈动脉窦是颈内动脉起始部的膨大处（D对）。颈动脉小球约为米粒大小（E对）。